32岁，外阴瘙痒伴分泌物多4~5天，妇科检查：阴道黏膜散在红色斑点，阴道内多量脓性泡沫状分泌物，有臭味。此病人确切诊断为
A. 细菌性阴道病
B. 真菌性阴道炎
C. 滴虫阴道炎
D. 淋球菌阴道炎
E. 外阴瘙痒症

正确答案：C。滴虫阴道炎

解析：中青年女性，外阴瘙痒伴分泌物多4～5天，妇科检查：阴道黏膜散在红色斑点（滴虫阴道炎典型体征），阴道内多量脓性泡沫状分泌物（滴虫阴道炎分泌物的典型特征），有臭味，根据患者的症状及体征，考虑最可能的诊断为滴虫阴道炎（C对），该病主要症状为阴道分泌物异常及外阴瘙痒，分泌物典型特点为稀薄脓性、泡沫状、有异味。细菌性阴道炎（A错）的分泌物特点是稀薄带有鱼腥臭味。真菌性阴道炎（B错）分泌物的特点为白色豆腐渣样或凝乳样。淋球菌阴道炎（D错）的分泌物为脓性，子宫颈多充血、水肿。